艾滋病病毒通过胎盘感染胎儿属于
A. 宫内传播
B. 产程传播
C. 产后传播
D. 妊娠传播
E. 分娩传播

正确答案：A。宫内传播

解析：本题考查艾滋病病毒通过胎盘的感染方式。宫内传播（A对）：妊娠期间，艾滋病病毒通过胎盘感染胎儿。产程传播（B错）：在分娩过程中，胎儿经过产道与带有艾滋病病毒的母血液或宫颈、阴道分泌物接触而感染艾滋病病毒。产后传播（C错）：艾滋病病毒感染母亲乳汁中含有艾滋病病毒，产后哺乳发生母婴传播。妊娠传播（D错）和分娩传播（E错）是干扰选项，没有此种说法。